患者，男性，68岁，右下牙龈癌，拟行颌颈联合根治术+胸大肌、肋骨复合组织瓣修复术。该患者行牙槽嵴裂植骨术的目的不包括
A. 为裂隙邻近的牙提供骨支持
B. 封闭口鼻瘘和前腭裂
C. 上颌骨前徙
D. 为支撑唇和鼻底提供一个稳定的支架
E. 恢复牙槽突骨的连续性

正确答案：C。上颌骨前徙

解析：本题考查牙槽嵴裂植骨术的目的。该患者行牙槽嵴裂植骨术的目的不包括上颌骨前徙（C错，为本题的正确答案）。牙槽突裂的手术治疗应达到以下几方面要求：（1）为裂隙邻近和未萌出的提供骨的支持（A对）；（2）封闭口鼻瘘和牙槽突裂（B对）；（3）提供稳固的上颌牙弓：牙槽突裂植骨术后能形成牙弓的连续性（E对）和整体牙槽突；（4）为支撑唇和鼻底提供一个稳固的支架（D对）；（5）不妨碍上颌骨发育。